具有耐氧化性和耐热性能，适用于pH值为1～12溶液滤过的是
A. 醋酸纤维素膜
B. 硝酸纤维素膜
C. 聚酰胺膜
D. 聚四氟乙烯膜
E. 聚偏氟乙烯膜

正确答案：E。聚偏氟乙烯膜